滤过除菌常用的滤板孔径是
A. 0.22～0.45μm
B. 0.50～0.75pμm
C. 0.80～0.95μm
D. 1～5μm
E. 5～10μm

正确答案：A。0.22～0.45μm